可抑制DNA聚合酶和少量掺入DNA，阻止DNA合成的药物是
A. 喜树碱
B. 硫酸长春碱
C. 多柔比星
D. 紫杉醇
E. 盐酸阿糖胞苷

正确答案：E。盐酸阿糖胞苷

解析：本题考查盐酸阿糖胞苷。可抑制DNA聚合酶和少量掺入DNA，阻止DNA合成的药物是盐酸阿糖胞苷（E对）。盐酸阿糖胞苷在体内经脱氧胞嘧啶激酶的催化下先转化为5-磷酸核苷酸(Ara-CMP)，Ara-CMP与核苷酸激酶反应形成二磷酸和三磷酸核苷酸(Ara-CDP和Ara-CTP)。喜树碱（A错）为拓扑异构酶抑制剂。硫酸长春碱（B错）和紫杉醇（D错）为微管蛋白活性抑制剂。多柔比星（C错）为DNA嵌入剂。